关于医生行使权利的错误提法是
A. 行使权利的自主性
B. 行使权利的权威性
C. 行使权利的特殊性
D. 可以行使特殊干涉权
E. 可以不经病人知情同意行使所有正当权利

正确答案：E。可以不经病人知情同意行使所有正当权利

解析：在医护实践中，尊重原则是指对患者的人格尊严及其自主性的尊重。患者的人格尊严是生下来即享有并应该得到肯定和保护的，并且具有主体性，而不能仅被当作工具或手段。患者的自主性是指患者对有关自己的医护问题，经过深思熟虑所作出的合乎理性的决定并据以采取的行动。如知情同意、知情选择、要求保守秘密和隐私等均是患者自主性的体现。掌握“医学伦理的基本原则”知识点。